水痘是由于感染以下哪种病原微生物
A. 麻疹病毒
B. 单纯疱疹病毒
C. EB病毒
D. 柯萨奇病毒
E. 带状疱疹病毒

正确答案：E。带状疱疹病毒

解析：水痘是由水痘-带状疱疹病毒（E对）引起的小儿常见急性出疹性传染病，临床特征为发热，皮肤黏膜分批出现的瘙痒性斑、丘、疱疹及结痂，且上述各期皮疹可同时存在。麻疹病毒（A错）引起麻疹。单纯疱疹病毒（B错）可引起龈口炎和脑炎等。EB病毒（C错）可引起传染性单核细胞增多症。柯萨奇病毒（D错）可引起疱疹性咽峡炎、脊髓灰质炎等。